患者，男，35岁。进食时左侧下颌下腺区肿胀、疼痛，停止进食数小时后，疼痛亦随之消退。检查见左侧导管口黏膜红肿，导管呈条索状，挤压腺体可见少许脓性分泌物自导管口溢出。如果结石位于下颌下腺内，最佳的治疗方法是
A. 全身抗生素治疗
B. 下颌下腺切开取石术
C. 下颌下腺导管结扎术
D. 下颌下腺切除术
E. 保守治疗

正确答案：D。下颌下腺切除术

解析：腺体切除术：适用于涎石位于下颌下腺内或下颌下腺导管后部、腺门部的涎石。下颌下腺反复感染或继发慢性硬化性下颌下腺炎、腺体萎缩，已失去摄取及分泌功能者。掌握“涎石病及下颌下腺炎”知识点。